患者，男性，35岁，牙龈刷牙出血4年余。进食时碰触亦出血，含漱后可止住。检查：牙龈红肿，探诊深度≤3mm，X线片：未见牙槽嵴顶吸收。此患者最可能的诊断是
A. 青春期龈炎
B. 慢性牙周炎
C. 慢性龈缘炎
D. 坏死性龈炎
E. 侵袭性牙周炎

正确答案：C。慢性龈缘炎

解析：本题考查慢性龈炎的临床表现。此患者主诉牙龈刷牙或咬硬物时出血，但无自发性出血，查体见牙龈红肿，探诊深度正常，切X线片未见牙槽嵴顶吸收。依据患者的主诉和临床检查可诊断为慢性龈缘炎（C对）。青春期龈炎（A错）患者处于青春期。慢性牙周炎（B错）患者有附着丧失，有牙槽骨的吸收。坏死性龈炎（D错）患者龈缘如虫蚀状，患处易出血，疼痛明显，有典型腐败性口臭。侵袭性牙周炎（E错）有好发牙位，且有附着丧失和牙槽骨的吸收。